高渗性缺水的患者常见的临床表现是
A. 兴奋、手足麻木
B. 头晕、视力减退
C. 淡漠、反应迟缓
D. 呆滞、嗜睡
E. 口渴、谵妄

正确答案：E。口渴、谵妄

解析：口渴为高渗性缺水时的常见表现（需注意：等渗、低渗性缺水并不出现口渴），谵妄属重症高渗性缺水患者出现的神经精神症状（E对）。头晕、视力减退（B错），淡漠、反应迟缓（C错），手足麻木（A错）均常见于低渗性缺水（P11）患者。嗜睡（D错）常见于水中毒（P13）患者。